下列叙述正确的是
A. 是输送卵子的膜性管道
B. 由卵巢前缘连至子宫
C. 位于子宫体的两侧
D. 位于子宫阔韧带的上缘内
E. 无

正确答案：D。位于子宫阔韧带的上缘内

解析：输送卵子的肌性管道（A错）为输卵管；输卵管由卵巢上端连至子宫（B错）；输卵管位于子宫底的两侧（C错）；输卵管位于子宫阔韧带上缘内（D对）。